铅对血液系统的损害为
A. 贫血
B. 白血病
C. 再生障碍性贫血
D. 高铁血红蛋白血症
E. 出血

正确答案：A。贫血